外用杀虫止痒，内服壮阳通便的药是
A. 雄黄
B. 硫黄
C. 轻粉
D. 明矾
E. 蛇床子

正确答案：B。硫黄